局麻作用起效快、作用强维持时间长且安全范围大的药物是
A. 普鲁卡因
B. 利多卡因
C. 丁卡因
D. 布比卡因
E. 依替卡因

正确答案：B。利多卡因

解析：利多卡因又称赛罗卡因，是目前应用最多的局麻药。相同浓度下与普鲁卡因相比，利多卡因具有起效快、作用强而持久、穿透力强以及安全范围较大等特点，同时无扩张血管作用及对组织几乎没有刺激性。可用于多种形式的麻醉，有全能麻醉药之称。掌握“局麻药”知识点。